正常人时间肺活量第1秒末呼出气量占肺活量的百分比是
A. 0.6
B. 0.63
C. 0.8
D. 0.96
E. 0.99

正确答案：C。0.8

解析：正常人时间肺活量第1秒末呼出气量（FEV₁.₀）占用力肺活量（FVC）的百分比即FEV₁.₀/FVC，均大于0.8（C对）。FEV₁.₀/FVC可用于肺功能不全的分级。当FEV₁.₀/FVC＞0.7时，肺功能基本正常；当FEV₁.₀/FVC在0.61～0.7之间，肺功能轻度减退；当FEV₁.₀/FVC在0.41～0.6之间，肺功能显著减退；当FEV₁.₀/FVC≤0.4时，肺功能严重减退。